主含蒽醌类成分的药材是
A. 决明子
B. 瓜蒌
C. 马钱子
D. 栀子
E. 槟榔

正确答案：A。决明子

解析：本题考查的是决明子的化学成分。主含蒽醌类成分的药材是决明子（A对）。决明子中含有蒽醌类、萘并吡咯酮类、脂肪酸类等化学成分。其中，蒽醌类化合物为其主要成分，含量约1%，主要为大黄酚、大黄素甲醚、决明素、橙黄决明素、黄决明素、美决明素、葡萄糖美决明素、葡萄糖橙黄决明素。《中国药典》以大黄酚、橙黄决明素为指标成分进行含量测定，含量分别不得少于0.20%和0.80%。马钱子（C错）成熟种子中生物碱含量为1.5%～5%，主要生物碱是士的宁（又称番木鳖碱）、马钱子碱及其氮氧化物，还含少量的10余种其他吲哚类生物碱，其中以士的宁含量居首，占总碱量的35%～50%，其次是马钱子碱，占总碱量的30%～40%。《中国药典》以士的宁和马钱子碱为指标成分进行含量测定，要求士的宁的含量应为1.20%～2.20%，马钱子碱的含量不得少于0.80%。栀子（D错）的有效成分主要是栀子苷、京尼平苷和京尼平苷酸，属于环烯醚萜苷。槟榔（E错）含槟榔碱、槟榔次碱，属于吡啶类生物碱。瓜蒌（B错）的化学成分，2022年考试指南未明确说明。